肺心病肺动脉高压形成的功能因素是
A. 慢性缺氧所致肺血管重建
B. 缺氧性肺血管收缩
C. 支气管肺感染和阻塞
D. 血液粘稠度增加
E. 气道炎症

正确答案：B。缺氧性肺血管收缩

解析：肺血管阻力增加的功能性因素是指缺氧、高碳酸血症和呼吸性酸中毒使肺血管收缩、痉挛，其中缺氧是肺动脉高压形成最重要的因素，称为缺氧性肺血管收缩（B对），缺氧时收缩血管的物质增多，如白三烯、5-HT、血小板活化因子，血管紧张素Ⅱ等使肺血管收缩，血管阻力增加，另外，缺氧使平滑肌细胞膜对钙离子的通透性增加，肌肉兴奋-收缩偶联效应增强，直接使肺血管平滑肌收缩。肺血管阻力增加的解剖学因素系指肺血管解剖结构的变化，形成肺循环血流动力学障碍，慢性缺氧所致肺血管重建，由于肺血管解剖结构的变化，称为肺动脉高压形成的解剖学因素（A错）。支气管肺感染和阻塞（C错）为阻塞性肺炎的病理改变。血液粘稠度增加（D错）是引起肺动脉高压的血流动力学因素，它既不属于功能性因素，也不属于解剖学因素。气道炎症（E错）为支气管哮喘的本质。